伴有肾功能不全的感染患者可以应用，但需要减少治疗剂量的抗菌药物是
A. 头孢他啶
B. 妥布霉素
C. 琥乙红霉素
D. 青霉素
E. 阿莫西林

正确答案：A。头孢他啶

解析：本题考查头孢他啶。应用头孢他啶（A对）时，肾功能不全者的用量需根据肾功能的降低程度而相应地减少。妥布霉素（B错）对肾功能减退者应避免应用。轻、中度肾功能不全者使用青霉素（D错）不需要减量，严重肾功能不全者应延长给药间隔或调整剂量。肾功能不全者使用琥乙红霉素（C错）和阿莫西林（E错）时一般无需减量，但严重肾功能损害者应适当减量。